能反馈抑制自身分泌的胃液成分是
A. 内因子
B. 碳酸氢盐
C. 盐酸
D. 胃蛋白酶
E. 黏液

正确答案：C。盐酸

解析：盐酸（C对）可直接抑制胃窦黏膜G细胞，使促胃液素释放减少：也能刺激胃黏膜S细胞分泌生长抑素，间接抑制促胃液素和胃酸的分泌。十二指肠内pH降到2.5以下时，也能抑制胃酸分泌。内因子（A错）可以促进维生素B₁₂的吸收。HCO₃⁻（B错）的主要作用是与胃黏膜表面的黏液（E错）联合形成黏液-碳酸氢盐屏障，可以有效地保护胃黏膜免受胃内盐酸和胃蛋白酶的损伤。胃蛋白酶（D错）能正反馈激活胃液的自身分泌。